对于乳牙外伤的患牙，对于距离替换期1～2年，可考虑采取的处理原则是
A. 保留
B. 拔除
C. 牙弓夹板
D. 根管治疗
E. 颌间结扎

正确答案：B。拔除

解析：本题考查牙外伤概述及乳牙外伤。在处理乳牙外伤时，应考虑该牙距离替换的时间，对接近替换期的牙齿（如：距替牙1～2年），可采取拔除（B对）的方法。